可摘局部义齿中主要起固位作用的部分为
A. 连接体
B. 卡环体
C. 卡环臂
D. （牙合）支托
E. 间接固位体

正确答案：C。卡环臂

解析：本题考查可摘局部义齿的组成。可摘局部义齿中主要起固位作用的部分为卡环臂（C对）。可摘局部义齿一般由支托、固位体、连接体、基托、人工牙等部件组成。1.卡环型直接固位体的组成：（1）卡环臂：为卡环的游离部，富有弹性。卡环臂尖位于倒凹区，是卡环产生固位作用的主要部分。卡环臂起始部分较坚硬，放置在非倒凹区，起稳定作用，防止义齿侧向移位。（2）卡环体（B错）又称卡环肩：为连接卡环臂、支托和小连接体的坚硬部分，环抱于基牙的非倒凹区，从邻面包过颊舌轴面角，可阻止义齿龈向和侧向移动，起稳定和支持义齿的作用，同时支撑卡环臂，因而要求卡环体要有较高的强度，不易变形，位于非倒凹区，且不影响咬合。（3）小连接体：为卡环、支托等与大连接体或基托相连的部分，主要起连接作用。连接体不能进人基牙或软组织倒凹区，以免影响就位。（4）（牙合）支托。2.间接固位体（E错）是用以辅助直接固位体固位的部件，主要起增强义齿的稳定，防止义齿发生翘起、摆动、旋转及下沉的作用，常用于游离端义齿。3.连接体（A错）是可摘局部义齿的重要组成部分，分大连接体和小连接体两类，将义齿各部分连接在一起，同时还有传递和分散（牙合）力的作用。4.（牙合）支托（D错）的作用：支承、传递（牙合）力；稳定义齿；防止食物嵌塞和恢复（牙合）关系。